第二类精神药品
A. 供医疗单位在医生指导下使用
B. 在省级新药特药商店零售
C. 在医药商店零售
D. 在医药商店凭盖有医疗单位公章的医生处方配方
E. 供县以上主管部门指定的医疗单位使用

正确答案：D。在医药商店凭盖有医疗单位公章的医生处方配方

解析：本题考查第二类精神药品。第二类精神药品在医药商店凭盖有医疗单位公章的医生处方配方（D对）。第二类精神药品零售企业应当凭执业医师开具的处方，按规定剂量销售第二类精神药品，并将处方保存2年备查。零售第二类精神药品时，处方应经执业药师或其他依法经过资格认定的药学技术人员复核；第二类精神药品一般每张处方不得超过7日常用量，禁止超剂量或者无处方销售第二类精神药品。第二类精神药品零售企业不得向未成年人销售第二类精神药品。在难以确定购药者是否为未成年人的情况下，可查验购药者身份证明。